以下选项中属于牙周疾病的三级预防的是
A. 牙列缺失可摘局部义齿修复，重建功能
B. 去除菌斑和其他刺激因子
C. 正确刷牙、定期口腔保健，维护口腔健康
D. X线定期追踪观察牙槽骨情况，采取适当的治疗
E. 早发现、早治疗，减轻牙周病的严重程度

正确答案：A。牙列缺失可摘局部义齿修复，重建功能

解析：三级预防是在牙周病发展到严重和晚期阶段所采取的治疗措施以及修复失牙，重建功能；并通过随访、口腔健康的维护，维持其疗效，预防复发。同时，还应治疗相关的全身性疾病，如糖尿病，增强牙周组织的抵抗力。掌握“牙周病流行病学及分级预防”知识点。